关于肾上端的描述，下列哪项是正确的
A. 宽而厚
B. 窄而厚
C. 宽而薄
D. 窄而薄
E. 呈三棱状

正确答案：C。宽而薄

解析：肾上端宽而薄，下端窄而厚（C对）。